下列哪项不是珠海会议提出的种植义齿成功的标准
A. 无疼痛
B. 无麻木
C. 龈炎可控制
D. 功能好
E. 咀嚼效率大于60%

正确答案：E。咀嚼效率大于60%

解析：1995年中华口腔医学会杂志社在珠海制定的种植成功标准为：①功能好；②无麻木，疼痛等不适；③自我感觉良好；④种植体周围X线无透射区；横行骨吸收不超过1/3，种植体不松动；⑤龈炎可控制；⑥无与种植体相关的感染；⑦对邻牙支持组织无损害；⑧美观；⑨咀嚼效率大于70%；⑩符合上述要求者5年成功率应达到85%以上；10年80%以上。掌握“牙种植手术及效果评估”知识点。